社区口腔卫生服务应把以下哪项放在首位
A. 社会效益
B. 经济效益
C. 国家利益
D. 人民健康
E. 粮食产量

正确答案：A。社会效益

解析：社区口腔卫生服务应把社会效益放在首位。掌握“社区口腔卫生服务”知识点。